女性，20岁。自幼咳嗽，经常于感冒后加重，咳大量脓痰，无咯血，考虑诊断为
A. 慢性支气管炎
B. 慢性肺脓肿
C. 支气管扩张症
D. 先天性支气管囊肿
E. 肺脓肿继发感染

正确答案：C。支气管扩张症

解析：本例患者为20岁青年，自幼咳嗽，感冒后加重，有诱发支气管扩张的呼吸道感染病史，咳大量脓痰（为支气管扩张的典型表现），符合支气管扩张症（C对）的诊断。慢性肺脓肿（B错）、肺脓肿继发感染（E错）一般有反复发热和咯血，持续数周到数月，且炎症累及壁层胸膜可引起与呼吸有关的胸痛，与本例患者临床症状不符。慢性支气管炎（A错）起病缓慢，病程长，反复急性发作而病情加重，主要症状是咳嗽咳痰伴有喘息，无大量脓痰，故不考虑诊断为慢性支气管炎。先天性支气管囊肿（D错）多数无症状，由常规胸部X线检查发现，囊肿较大，压迫肺组织和纵膈时，可有呼吸困难、咳嗽和发绀等；继发感染则出现发热、胸痛、咳嗽咯痰、咯血等症状。